男，75岁。车祸致多发骨折及脾破裂，行脾切除术后5天，卧床制动。今晨突发胸闷气促，伴意识不清。查体：T37.4℃，P105次/分，R25次/分，BP94/58mmHg，SaO₂90%。引起该患者上述表现最可能的原因是
A. 自发性气胸
B. 急性左心衰竭
C. 心肌梗死
D. 脑出血
E. 肺栓塞

正确答案：E。肺栓塞

解析：老年男性患者，术后卧床制动（肺栓塞常见诱因），今晨突发胸闷、气促，伴意识不清，查体：P105次/分（增快，正常60～100次/分），R25次/分（增快，正常16～20次/分），BP94/58mmHg（提示休克），SaO₂90%（降低，正常为95～98%）。结合患者病史、临床表现、体征等，最可能的诊断为肺栓塞（E对）。自发性气胸（A错）患者可能有持重物 、屏气、 剧烈体力活动等诱因，多数起病急骤，突感一侧胸痛，继之出现胸闷和呼吸困难，阵发性刺激咳嗽等临床表现。脑出血（D错）患者多有高血压、脑血管病变等基础疾病，患者突发剧烈头痛，继之意识模糊，半身不遂，口眼歪斜，言语不利，严重者危及生命。